患者因龋坏一次充填后，冷热痛，去除刺激可恢复，但无自发痛。以下哪项不是造成患牙冷热痛的原因
A. 充填未垫底
B. 诊断失误
C. 操作时不当
D. 充填材料选择不当
E. 充填体悬突

正确答案：E。充填体悬突

解析：本题考查充填后疼痛。患者因龋坏一次充填后，冷热痛，去除刺激可恢复，但无自发痛。充填体悬突（E错，为本题的正确答案）不是造成患牙冷热痛的原因。充填体悬突压迫牙龈，可造成牙龈发炎，出现可定位的自发性疼痛，与温度刺激无关。中龋、深龋未垫底直接充填，冷热刺激可通过充填体刺激牙髓，导致牙髓充血，出现激发痛（A对）。若患牙牙髓已有充血症状，但不明显，被误诊为正常牙髓而直接进行垫底充填，充填后可出现激发痛（B对）。在备洞过程中操作不当，如用过冷的水冲洗窝洞或连续钻磨等，可激惹牙髓导致牙髓充血，出现激发痛（C对）。充填材料选择不当，刺激性的充填材料可造成对牙髓的化学刺激，导致牙髓充血，继而出现冷热刺激痛（D对）。